初产妇，34岁，孕39周，规律宫缩2小时，宫口开大4cm，给予肌注缩宫素3u，宫缩持续不缓解，胎心率为90～100/分，缩复环上升达脐平，应考虑的诊断是
A. 胎盘早剥
B. 痉挛性子宫收缩
C. 高张性宫缩乏力
D. 先兆子宫破裂
E. 子宫收缩过强

正确答案：D。先兆子宫破裂

解析：患者腹部缩复环上升至平脐，说明此环是病理性缩复环，病理性缩复环是先兆子宫破裂的特征性表现，故应考虑的诊断是先兆子宫破裂（D对）。根据病情严重程度将胎盘早剥分为3度∶①Ⅰ度：胎盘剥离面积小、多见于分娩期，可见轻度腹痛或无腹痛，贫血不明显…产后检查胎盘母体面有陈旧凝血块及压迹…（A错）。子宫收缩过强时，可能会出现子宫痉挛性狭窄环，此环的特点是不随宫缩上升（BE错）。张性宫缩乏力，是由于子宫收缩失去其极性和对称性，频率及强度亦不规则，子宫的收缩完全不协调，以致子宫肌肉在间歇期并不完全放松，处于持续紧张状态，而子宫腔内的压力及子宫的张力处于高张状态，因而不能发生有效宫缩，影响产程进展和宫口扩张（C错）。